病例对照研究资料的主要分析指标是
A. 患病率
B. 比值比
C. 相对危险度
D. 某病病死率
E. 某病死亡人数

正确答案：B。比值比

解析：本题考查病例对照研究的分析指标。在病例对照研究中，没有暴露组和非暴露组的观察人数，不能计算发病率，因此不能直接计算RR，但可用比值比（B对ACDE错）来描述暴露与疾病的联系强度。比值比又称比数比、优势比，为病例组与对照组两组暴露比值之比。